男性，20岁，1年来反复踝部水肿，血压120/80mmHg，尿蛋白定量为3.0g/24h，RBC（10~15）个/HP，诊断最可能为
A. 急性肾小球肾炎
B. 肾病综合征
C. 隐置型肾小球肾炎
D. 慢性肾小球肾炎
E. 以上都不是

正确答案：D。慢性肾小球肾炎